吗啡禁用于
A. 分娩镇痛
B. 胃肠绞痛
C. 肾绞痛
D. 晚期癌痛
E. 心肌梗死剧痛

正确答案：A。分娩镇痛